主动脉瓣狭窄的杂音特点是
A. 递增型
B. 递减型
C. 一贯型
D. 先增强后减弱
E. 先减弱后增强

正确答案：D。先增强后减弱

解析：主动脉瓣狭窄典型杂音为：粗糙而响亮的射流性杂音，3/6级以上，呈递增－递减型（D对）。二尖瓣狭窄特征性的杂音为心尖区舒张中晚期低调的隆隆样杂音，呈递增型（A错），严重肺动脉高压时，由于肺动脉及其瓣环的扩张，导致相对性肺动脉瓣关闭不全，因而在胸骨左缘第2肋间可闻及递减型（B错）高调叹气样舒张早期杂音（即Graham-Steel杂音）（P287-288）。二尖瓣关闭不全时可在心尖区闻及＞3/6级的收缩期一贯型（C错）粗糙的吹风样杂音（P292）。